中药中存在较普遍的芳香族有机酸有
A. 对羟基桂皮酸
B. 咖啡酸
C. 阿魏酸
D. 芥子酸
E. 奎宁

正确答案：A、B、C、D。对羟基桂皮酸；咖啡酸；阿魏酸；芥子酸

解析：本题考查的是芳香族有机酸。中药中存在较普遍的芳香族有机酸有对羟基桂皮酸（A对）、咖啡酸（B对）、阿魏酸（C对）与芥子酸（D对）。芳香族有机酸：芳香酸在植物界中分布十分广泛，如羟基桂皮酸的衍生物普遍存在于中药中，尤以对羟基桂皮酸、咖啡酸、阿魏酸和芥子酸较为多见。奎宁（E错）属于生物碱，可与Mandelin试剂（1%钒酸铵的浓硫酸溶液）反应显淡橙色。